邪热炽盛，煎灼津液，伤及营血，燔灼肝经，可以形成
A. 风气内动
B. 寒从中生
C. 寒从中生
D. 津伤化燥
E. 火热内生

正确答案：A。风气内动

解析：邪热炽盛，煎灼津液，伤及营血，燔灼肝经，致使筋脉失养，动而生风。（A对）。